根据《药品管理法》规定，从某国进口动脉粥样硬化药品，海关放行应持有
A. 《医药产品注册证》
B. 《进口准许证》
C. 《进口药品注册证》
D. 《药品经营许可证》
E. 《进口药品通关单》

正确答案：E。《进口药品通关单》

解析：本题考查药品进口管理。根据《药品管理法》规定，从某国进口动脉粥样硬化药品，海关放行应持有《进口药品通关单》（E对）。第五章药品管理第三十七条：进口药品到岸后，进口单位应当持《进口药品注册证》（C错）或者《医药产品注册证》（A错）以及产地证明原件、购货合同副本、装箱单、运单、货运发票、出厂检验报告书、说明书等材料，向口岸所在地药品监督管理部门备案。口岸所在地药品监督管理部门经审查，提交的材料符合要求的，发给《进口药品通关单》。进口单位凭《进口药品通关单》向海关办理报关验放手续。口岸所在地药品监督管理部门应当通知药品检验机构对进口药品逐批进行抽查检验；但是，有《药品管理法》第四十一条规定情形的除外。药品进口备案，应当向货物到岸地口岸药品监督管理局提出申请，并由负责本口岸药品检验的口岸药品检验所进行检验。办理进口备案，报验单位应当填写《进口药品报验单》，持《进口药品注册证》（或者《医药产品注册证》）（正本或者副本）原件，进口麻醉药品、精神药品还应当持麻醉药品、精神药品《进口准许证》（B错）原件，向所在地口岸药品监督管理局报送所进口品种的有关资料一式两份。国家对药品经营实施许可制度，在中华人民共和国境内除药品上市许可持有人自行批发药品外，经营药品必须依法待有《药品经营许可证》（D错）。